男性，27岁。尿频、尿急、尿痛1年，一般抗炎治疗不好转，时有低热无力，尿检：白细胞20～30/HP，红细胞5个/HP，肾图：右肾功能严重受损，左肾积水。初诊为肾结核，为确诊应作哪项检查意义更大
A. IVU
B. B超
C. CT
D. 肾动脉造影
E. 血常规

正确答案：A。IVU

解析：患者初诊为肾结核，为了明确诊断可选择尿结核杆菌培养、尿沉渣找抗酸杆菌或IVU（静脉尿路造影）（A对）。IVU可以了解分侧肾功能、病变程度和范围，对肾结核的诊断和治疗具有重要意义。B超（B错）可以确定病变部位、显示病肾结构，但对确诊肾结核价值不大。CT（C错）可显示扩大的肾盂肾盏、皮质空洞及钙化灶，虽有助于肾结核的诊断，但不如IVU好。肾动脉造影（D错）主要用于肾血管疾病、肾损伤和肾实质肿瘤等，对诊断肾结核价值不大。血常规（E错）为常规检查，缺乏特异性，对确诊肾结核价值不大。